医生的特殊干涉权应不包括
A. 控制想要自杀的患者的行为
B. 依法隔离SARS患者
C. 中止出现高度危险的治疗性人体实验
D. 拒绝病人放弃治疗的要求
E. 隐瞒真相，不对患者诉说不良诊断和预后

正确答案：D。拒绝病人放弃治疗的要求